亚硝酸盐食物中毒的机理是
A. 巯基酶失活
B. 胆碱酯酶活性被抑制
C. 溶血作用
D. 低铁血红蛋白氧化成高铁血红蛋白
E. 毛细血管扩张

正确答案：D。低铁血红蛋白氧化成高铁血红蛋白